下列关于非参数统计叙述中错误的是
A. 不受总体分布形式是否已知的限定
B. 适用范围广
C. 不要求资料服从特定的分布
D. 计算简便
E. 对服从正态分布的资料，其检验效率也同样高

正确答案：E。对服从正态分布的资料，其检验效率也同样高